胃食管反流病治疗措施不包括
A. 应用促胃肠动力药
B. 抗酸治疗
C. 高脂肪饮食
D. 减肥
E. 避免饮用咖啡和浓茶

正确答案：C。高脂肪饮食

解析：轻症胃食管返流病患者可以选用促胃肠动力药（A对），通过增加LES压力、改善食管蠕动功能、促进胃排空，从而减少胃内容物食管返流及减少其在食管的暴露时间。抗酸治疗（B对）主要用于症状轻、间歇发作的患者。此外，胃食管返流患者应减少增高腹压的因素如肥胖（D对）以减少反流；避免高脂肪饮食（C错，为本题正确答案）、咖啡和浓茶（E对）。